分布于腮腺表面皮肤的感觉神经是
A. 枕大神经
B. 枕小神经
C. 耳大神经
D. 耳颞神经
E. 颊神经

正确答案：D。耳颞神经

解析：分布于腮腺表面皮肤的感觉神经是耳颞神经（D对）。枕大神经（A错）分布于枕、项部皮肤。枕小神经（B错）分布于枕部及耳郭背面上部的皮肤。耳大神经（C错）分布于耳郭及附近皮肤。颊神经（E错）分布于颊部皮肤及口腔侧壁黏膜。